男孩，4岁。咳嗽3个月，痰不多，常于夜间咳醒，活动后加重，无发热，使用抗生素无明显好转。既往有湿疹史。查体：T36.5℃，P100次/分，R20次/分，双肺呼吸音粗，未闻及干湿性啰音，腹软，无压痛。最可能的诊断是
A. 喘息性支气管炎
B. 支气管肺炎
C. 咳嗽变异型哮喘
D. 支气管异物
E. 支气管炎

正确答案：C。咳嗽变异型哮喘

解析：患者男孩，4岁。咳嗽3个月，痰不多，常于夜间咳醒，活动后加重，无发热，使用抗生素无明显好转。既往有湿疹史。符合咳嗽变异型哮喘诊断基本标准。最可能的诊断是咳嗽变异型哮喘。（C对）支气管异物有异物吸入史，突然出现呛咳，可有肺不张和肺气肿。（D错）支气管肺炎一般有发热，咳嗽，呼吸急促的症状，肺部听诊闻及中，细湿啰音和（或）胸部影像学有胸部肺炎的改变均可诊断为支气管肺炎。（B错）喘息性支气管炎大多数在上呼吸道感染2-3天后出现呼气性呼吸困难，呼吸急促和鼻翼煽动，严重时可出现三凹症。两肺听诊以哮鸣音为主，呼气延长，常伴中等湿啰音。（A错）支气管炎大多数先有上呼吸道感染症状，之后以咳嗽为主要症状，开始为干咳，以后有痰。（E错）